抑制延脑咳嗽中枢而产生镇咳作用的药物是
A. 二丙酸倍氯米松
B. 可待因
C. 沙丁胺醇
D. 氨茶碱
E. 色甘酸钠

正确答案：B。可待因

解析：本题考查可待因。抑制延脑咳嗽中枢而产生镇咳作用的药物是可待因（B对）。可待因抑制延髓咳嗽中枢，镇咳作用为吗啡的1/10，镇咳剂量不抑制呼吸。二丙酸倍氯米松（A错）为糖皮质激素，主要用于其他药物无效的哮喘持续状态和重症哮喘，无中枢性镇咳作用。沙丁胺醇（C错）、氨茶碱（D错）、色甘酸钠（E错）均为平喘药。